男，32岁。支气管哮喘，20年。喘息加重1周。意识恍惚1天来急诊。查体：T37.5℃，P94/分，面色暗红，口唇发绀。可见胸腹矛盾运动，双肺呼吸音低，可闻及低调哮鸣音。该患者此时最可能出现的动脉血气变化
A. PaO₂降低、PaCO₂降低、PH升高
B. PaO₂降低、PaCO₂升高、PH降低
C. PaO₂降低、PaCO₂升高、PH升高
D. PaO₂降低、PaCO₂升高、PH正常
E. PaO₂降低、PaCO₂正常、PH降低

正确答案：B。PaO₂降低、PaCO₂升高、PH降低

解析：男，32岁。支气管哮喘，20年（哮喘病史）。喘息加重1周。意识恍惚1天来急诊。查体：T37.5℃，P94/分，面色暗红，口唇发绀。可见胸腹矛盾运动，双肺呼吸音低，可闻及低调哮鸣音。根据病史、临床表现、体征，最可能的诊断为重症哮喘。该患者病情危重，此时最可能出现的动脉血气变化为PaO₂降低、PaCO₂升高、PH降低（B对）。